下列有关社会、家庭因素（“社会经济因素”）对生长发育的影响作用描述不正确的是
A. 影响体格发育，也影响心理、智力和行为发展
B. 只能与其他社会因素（如居住状况等）共同作用，不具有独立性
C. “社会经济因素”包括生活方式、家庭气氛和生活制度等
D. 双亲受教育水平对生长发育的影响作用超过经济收入
E. “社会经济因素”可以用量表方式评估对生长发育的综合影响

正确答案：B。只能与其他社会因素（如居住状况等）共同作用，不具有独立性